肝细胞肝癌时主要增高的是
A. 血淀粉酶检测
B. 血清甲胎蛋白检测
C. 腹部CT检查
D. 血CEA
E. 绒毛膜激素

正确答案：B。血清甲胎蛋白检测

解析：肝细胞肝癌时主要增高的是甲胎蛋白（B对）。其是诊断原发性肝癌的特异性肿瘤标志物，具有确立诊断、判断治疗效果和预后的作用。血淀粉酶检测（A错）用于诊断胰腺疾病（P396）。腹部CT检查（C错）是诊断肝细胞癌的影像学诊断方法。血CEA（癌胚抗原）（D错）升高常见于胰腺癌、胃癌、结直肠癌、乳腺癌和肺癌（P419）。绒毛膜激素（E错）升高主要见于妊娠和滋养细胞肿瘤。